分布于胃的神经
A. 三叉神经
B. 面神经
C. 舌咽神经
D. 迷走神经
E. 副神经

正确答案：D。迷走神经

解析：三叉神经（A错）主要传导咀嚼肌和眼外肌的本体感觉以及面部皮肤、眼及眶内、口腔、鼻腔、鼻旁窦的黏膜、牙齿、脑膜等，传导痛、温、触等浅感觉。面神经（B错）主要支配面部表情肌。舌咽神经（C错）主要传导舌后1/3的味觉。迷走神经（D对）在胃部发出胃前支和胃后支。副神经（E错）主要支配胸锁乳突肌和斜方肌。